循行于下肢外侧中线的经脉是
A. 手少阴心经
B. 足少阳胆经
C. 足少阴肾经
D. 足厥阴肝经
E. 手太阴肺经

正确答案：B。足少阳胆经

解析：十二经脉在四肢部的分布规律：手经行于上肢，足经行于下肢；阴经行于内侧面，阳经行于外侧面。按正立姿势，两臂自然下垂拇指向前的体位描述：手足阴经为太阴在前缘、厥阴在中线少阴在后缘；手足阳经为阳明在前缘、少阳在中线、太阳在后缘；足厥阴肝经有例外，即内踝尖上八寸以下为厥阴行于前，太阴行于中，少阴仍在后。根据此规律，足经行于下肢，阳经行于外侧，少阳行于中线（B对）。